蜈蚣的性状特征有
A. 呈扁平长条形，头部和躯干部共 22个环节
B. 头部黑色
C. 躯干部从第二背板起均为棕绿色或墨绿色
D. 步足黄色或红褐色，弯作钩状，最末一对为尾足
E. 气微腥，有刺鼻的臭气，味辛而微咸

正确答案：A、D、E。呈扁平长条形，头部和躯干部共 22个环节；步足黄色或红褐色，弯作钩状，最末一对为尾足；气微腥，有刺鼻的臭气，味辛而微咸